治疗水肿风水泛滥证，应首选
A. 越婢加术汤
B. 麻黄连翘赤小豆汤合五味消毒饮
C. 五皮饮合胃苓汤
D. 实脾饮
E. 疏凿饮子

正确答案：A。越婢加术汤

解析：越婢加术汤功效为宣肺清热、祛风利水，为风水相搏的首选方（A对）。麻黄连翘赤小豆汤合五味消毒饮，二方合用共起宣肺利水，清热解毒之功，可用于水肿之湿毒浸淫证(B错)。五皮饮合胃苓汤，其功用前者为理气化湿利水，后者为通阳利水，燥湿运脾，两方合用共起运脾化湿，通阳利水之功，适用于水肿之水湿浸渍证（C错）。实脾饮，其功用为温阳健脾，行气利水，可用于水肿之脾阳虚衰证（D错）。疏凿饮子，其功用为泻下逐水，疏风发表，可用于水肿之湿热壅盛证（E错）。